与舌咽神经无关的核团是
A. 上泌涎核
B. 疑核
C. 三叉神经脊束核
D. 孤束核
E. 下泌涎核

正确答案：A。上泌涎核

解析：舌咽神经含有5种纤维成分，①特殊内脏运动纤维，起于疑核（B错），支配茎突咽肌；②一般内脏运动纤维，起于下泌涎核（E错），支配腮腺分泌；③一般内脏感觉纤维，传导咽、舌后1/3、咽鼓管和鼓室等处黏膜感觉，纤维止于孤束核（D错）下部；④特殊内脏感觉纤维，传导舌后1/3味觉，纤维止于孤束核（D错）上部；⑤一般躯体感觉纤维，传导耳后皮肤感觉，纤维止于三叉神经脊束核（C错）。因而与舌咽神经无关的核团是上泌涎核（A对）。